可导致患者出现严重伪膜性肠炎的药物是
A. 替考拉宁
B. 万古霉素
C. 克林霉素
D. 阿奇霉素
E. 利奈唑胺

正确答案：C。克林霉素

解析：本题考查克林霉素的不良反应。克林霉素（C对）口服、注射均可引起胃肠道反应，少数患者由于正常肠道菌部分被抑制，而不敏感细菌过度繁殖出现伪膜性肠炎。替考拉宁（A错）不良反应主要为过敏反应。万古霉素（B错）不良反应主要表现为耳、肾毒性。阿奇霉素（D错）不良反应为胃肠道反应。利奈唑胺（E错）不良反应主要为消化道反应。